患者，男，70岁，近期发现骨痛，疲乏，驼背。临床诊断为老年性骨质疏松症。该患者不宜选用的药物是
A. 降钙素
B. 维生素D
C. 阿仑膦酸钠
D. 碳酸钙
E. 雷洛昔芬

正确答案：E。雷洛昔芬

解析：本题考查骨质疏松症的药物治疗。该患者不宜选用的药物是雷洛昔芬（E错，为本题正确答案）。雷洛昔芬用于绝经后女性骨质疏松的防治，本题中患者为男性。钙剂（如降钙素（A对）和碳酸钙（D对））、维生素D（B对）和骨吸收抑制剂（如阿仑膦酸钠（C对））的三联药物用于骨质疏松症治疗。